椎弓板之间的直接连结
A. 椎间盘
B. 黄韧带
C. 棘间韧带
D. 棘上韧带
E. 关节突关节

正确答案：B。黄韧带

解析：黄韧带连结相邻两椎弓板（B对）。棘间韧带连结相邻棘突（D错）。棘上韧带是连结胸、腰、骶椎各棘突尖之间的纵行韧带” （C错）。关节突关节由相邻椎骨的上、下关节突的关节面构成，属平面关节（E错）。椎间盘是连结相邻两个椎体的纤维软骨盘（A错）。